传染病的病原学检查方法不包括
A. 病毒分离
B. 细菌培养
C. 病原体核酸检测
D. 特异性抗原检测
E. 粪便涂片革兰染色

正确答案：E。粪便涂片革兰染色

解析：细菌培养（B对）和病毒分离（A对）属于分离培养病原体，是传染病病原学的检查方法。病原体核酸检测（C对）属于检测特异性核酸，它和特异性抗原检测（D对）也都属于传染病病原学检查方法。粪便涂片革兰染色（E错，为本题正确答案）属于一般实验室检查。